贮存饮片时，水分应严格控制在
A. 1%～5%之间
B. 5%～9%之间
C. 9%～13%之间
D. 13%～17%之间
E. 17%～21%之间

正确答案：C。9%～13%之间